患者，男性，42岁。因车祸致肝脾破裂和右股骨骨折，急诊手术抢救。手术后12小时逐渐出现呼吸困难，临床拟诊急性呼吸窘迫综合征（ARDS）。下列检查项目哪一项没有意义
A. X线胸部摄片
B. 动脉血气分析
C. 肺顺应性检测
D. 肺动脉楔嵌压检测
E. 峰流率（PEFR）检测

正确答案：E。峰流率（PEFR）检测

解析：峰流率测定反映气道阻塞有无及其程度，ARDS患者不存在气道阻塞。掌握“急性呼吸窘迫综合征”知识点。